低钾血症的心电图特点是
A. QRS波增宽，ST段下移，T波低平，u波有
B. QRS波增宽，ST段正常，T波低平，u波无
C. QRS波宽，ST段上移，T波高尖，u波无
D. QRS波变窄，ST段下移，T波高尖，u波无
E. QRS波变窄，ST段正常，T波正常，u波有

正确答案：A。QRS波增宽，ST段下移，T波低平，u波有

解析：低钾血症的心电图特点有：代表复极化2期的ST段压低（BCE错）；相当于复极化3期的T波低平（D错）和U波增高（超常期延长所致）；相当于心室动作电位时间的Q-T(或Q-U)间期延长；严重低钾血症时还可见 P波增高、PQ间期-延长和QRS波群增宽（A对）。